茯苓与薏苡仁均有的功效是
A. 利水渗湿，安神
B. 利水渗湿，除痹
C. 利水渗湿，泄热
D. 利水渗湿，排脓
E. 利水渗湿，健脾

正确答案：E。利水渗湿，健脾

解析：本题考查茯苓与薏苡仁的功效。茯苓与薏苡仁均有的功效是利水渗湿，健脾（E对）。茯苓【功效】利水渗湿，健脾，安神（A错）。薏苡仁【功效】利水渗湿，健脾止泻，除痹（B错），清热排脓（D错）。泽泻【功效】利水渗湿，泄热（C错）。